正确描述头静脉的是
A. 起于手背静脉网尺侧
B. 沿前臂和臂内侧上行
C. 为上肢的深静脉
D. 在臂中部穿深筋膜，注入肱静脉
E. 行走在三角胸大肌间沟内，穿深筋膜注入锁骨下静脉或腋静脉

正确答案：E。行走在三角胸大肌间沟内，穿深筋膜注入锁骨下静脉或腋静脉

解析：头静脉起自手背静脉网的桡侧（A错）。沿前臂下部的桡侧（B错）、前臂上部和肘部的前面以及肱二头肌外侧沟上行。行走在三角胸大肌间沟内，至锁骨下窝穿深筋膜注入腋静脉或锁骨下静脉（E对D错）。